检查粪便，前三天不必禁食的食物是
A. 绿叶蔬菜
B. 肝脏
C. 动物血
D. 肉类
E. 果酱

正确答案：E。果酱

解析：粪便隐血检测，患者应素食3日（BCD对），并禁止服用铁剂及维生素C（A对），否则易出现假阳性（E错，为本题正确答案）。